属于第三信使的是
A. cGMP
B. Ca²⁺
C. cAMP
D. 肾上腺素
E. 转化因子

正确答案：E。转化因子

解析：本题考查第三信使。属于第三信使的是转化因子（E对）。第三信使是指负责细胞核内外信息传递的物质，包括生长因子、转化因子等，其转导蛋白以及某些癌基因产物，参与基因调控、细胞增殖和分化以及肿瘤的形成等过程。cGMP（A错）、Ca²⁺（B错）、cAMP（C错）均为第二信使。肾上腺素（D错）为第一信使。